阻塞性肺炎的缺氧机制是
A. 通气血流比例失调
B. 肺泡通气量不足
C. 氧弥散功能失调
D. 分流率增加
E. 呼吸功能增加

正确答案：A。通气血流比例失调

解析：通气血流比例失调（A对）是阻塞性肺气肿加重的缺氧机制，大量肺泡周围的毛细血管受肺泡膨胀的挤压而退化，致使肺毛细血管大量减少，肺泡间的血流量减少，此时肺泡虽有通气，但肺泡壁无血液灌流，导致生理无效腔量增大，从而导致通气血流比例失调。肺泡通气量不足（B错），肺泡通气量减少会引起PaO₂下降和PaCO₂上升，从而发生缺氧和CO₂潴留，常为II型呼吸衰竭主要的机制；氧弥散功能失调（C错），指O₂、CO₂等气体通过肺泡膜进行交换的物理弥散过程发生障碍，常为I型呼吸衰竭的主要机制；分流率增加（D错），肺动脉内的静脉血未经氧合直接流入肺静脉，导致PaO₂降低，是通气/血流比例失调的特例，常见于肺动-静脉瘘；呼吸功能增加（E错），发热、寒战、呼吸困难和抽搐均增加氧耗量，氧耗量增加导致肺泡氧分压下降时，正常人可通过增加通气量来防止缺氧的发生。